下列属于未知职业性有害因素的识别和鉴定方法的是
A. 类比法
B. 实验研究
C. 检査表法
D. 工程分析法
E. 经验法

正确答案：B。实验研究